龈炎最常见的主诉症状是
A. 疼痛
B. 发痒
C. 干燥
D. 出血
E. 脓肿

正确答案：D。出血

解析：本题考查龈炎最常见的主诉症状。菌斑使牙龈结缔组织中的毛细血管扩张充血，血管壁变脆，在刷牙等刺激时血管极易破裂出血，所以龈炎最常见的主诉症状是出血（D对），患者多在刷牙或咬硬物时牙龈出血，这也是患者就诊的主要原因。龈炎自觉症状不明显，无明显疼痛（A错），疼痛不是龈炎最常见的主诉症状。有些患者牙龈发痒（B错），但患者不会因牙龈发痒去就诊。龈炎有炎性渗出物，没有干燥感（C错）。龈炎伴发化脓性感染时可形成脓肿（E错），不是常见症状。